患者男，59岁，体胖，多年吸烟，近1年常有劳累性心前区疼痛，日前丧母而致心前区剧痛，并向左肩放射。入院时检查：神志模糊，心电图示广泛心肌缺血，抢救无效死亡。其死因最大的可能是
A. 心肌炎
B. 高血压性心脏病，心力衰竭
C. 急性心肌梗死
D. 心肌病
E. 脑出血

正确答案：C。急性心肌梗死

解析：患者心前区剧痛且有一年病史，向左肩放射为心肌梗死典型的疼痛部位，心电图检查为广泛心肌缺血进一步帮助诊断（C对）。心肌炎可有较剧烈而持久的心前区疼痛，但疼痛与发热同时出现（A错）。高血压性心脏病，心力衰竭中左心衰竭以肺淤血及心排血量降低致组织器官低灌注等临床表现为主，右心衰竭以以体循环静脉淤血的表现为主（B错）。心肌病的临床表现主要是心力衰竭和心律失常（D错）。脑出血时，可有头痛、眩晕、呕吐、意识丧失、肢体瘫痪、偏盲或失语、感觉障碍等表现（E错）。